六一散的功效是
A. 芳香化湿
B. 和中消食
C. 清暑利湿
D. 辟瘟解毒
E. 健脾，祛暑

正确答案：C。清暑利湿

解析：本题考查的是六一散的功能。六一散的功效是清暑利湿（C对）。六一散：【功能】清暑利湿。甘露消毒丸：【功能】芳香化湿（A错），清热解毒。六合定中丸：【功能】祛暑除湿，和中消食（B错）。紫金锭：【功能】辟瘟解毒（D错），消肿止痛。功能为健脾、祛暑（E错）的中成药，2022年考试指南未明确说明。